急性呼吸性酸中毒时机体的主要代偿方式是
A. 呼吸代偿
B. 肾脏代偿
C. 细胞内缓冲及细胞内外离子交换
D. 骨骼代偿
E. 细胞外液缓冲

正确答案：C。细胞内缓冲及细胞内外离子交换

解析：急性呼吸性酸中毒时机体的主要代偿方式是细胞内缓冲及细胞内外离子交换（C对），肾脏的调节作用发挥较慢，常在酸碱平衡紊乱发生后12 -24小时才发挥作用。